患儿男，8个月。近1个月面色苍白。患儿系34周早产，生后母乳喂养，未加辅食。查体：皮肤黏膜苍白，心前区可闻及Ⅱ级收缩期吹风样杂音。肝肋下3cm，脾肋下1cm。红细胞3.0×10¹²/L，血红蛋白71g/L。外周血涂片示红细胞形态大小不等，以小细胞为主，中央变淡。根据目前诊断，主要治疗应是
A. 铁剂＋维生素C
B. 铁剂＋维生素B₁₂
C. 泼尼松＋丙酸睾酮
D. 脾切除
E. 铁剂＋维生素C＋输血

正确答案：A。铁剂＋维生素C

解析：本题考查贫血的治疗。根据该患儿的病情描述，患儿属于营养性缺铁性贫血，此时应首选铁剂治疗，铁剂与维生素C（A对BCDE错）同服能够促进铁的吸收，营养性缺铁性贫血患儿输血治疗的指征是贫血严重影响心肺功能或伴有严重感染，故该患儿不需输血治疗。